X-连锁低丙球蛋白血症是属于
A. T细胞缺陷
B. 联合免疫缺陷
C. 吞噬细胞缺陷
D. 补体缺陷病
E. B细胞缺陷病

正确答案：E。B细胞缺陷病

解析：X-连锁低丙球蛋白血症属于B细胞缺陷的典型疾病，原因是B细胞发育和（或）功能异常引起，以Ig减少或缺乏为特征，临床表现为反复化脓性细菌感染及对某些病毒（如脊髓灰质炎病毒）的易感性增加。掌握“免疫缺陷概述及原发性、获得性免疫缺陷病”知识点。